患者因左下6远中邻（牙合）面深龋，充填治疗一段时间后脱落。可能有以下几方面原因，除了
A. 窝洞制备时深度不够
B. 固位洞形不良
C. 继发龋发生
D. 充填物未垫底
E. 充填材料比例不当

正确答案：D。充填物未垫底

解析：本题考查充填体折断、脱落的原因。患者因左下6远中邻（牙合）面深龋，充填治疗一段时间后脱落。可能有以下几方面原因，除了充填物未垫底（D错，为本题的正确答案）。中龋、深龋未垫底直接充填银汞合金可传导冷热刺激产生激发痛；复合树脂直接充填可造成对牙髓的化学刺激而激惹牙髓产生疼痛，但充填体不会折断脱落。窝洞制备深度不够，导致充填材料过薄，在承受咀嚼压力时易折断脱落（A对）。固位形不良，充填体在受到侧向力或垂直向力作用时易脱落（B对）。当原有龋病病变未去除干净，发生继发龋，唾液进入，粘结剂溶解，充填体不密合，龋病病变范围扩展，最终导致充填体脱落（C对）。充填材料比例不当可使充填材料性能下降，粘结不牢固，易脱落（E对）。